严重营养不良反应会导致剥脱性皮炎的药物是
A. 秋水仙碱
B. 苯溴马隆
C. 非布司他
D. 碳酸氢钠
E. 别嘌醇

正确答案：E。别嘌醇

解析：本题考查别嘌醇的不良反应。别嘌醇（E对）典型的不良反应有剥脱性皮炎、血小板计数减少、少尿、尿频、间质性肾炎。